能消肿排脓的药是
A. 白芷
B. 藁本
C. 苍耳子
D. 蔓荆子
E. 淡豆豉

正确答案：A。白芷

解析：本题考查白芷的功效。能消肿排脓的药是白芷（A对）。白芷【功效】发散风寒，通窍止痛，燥湿止带，消肿排脓。藁本（B错）【功效】发表散寒，祛风胜湿，止痛。苍耳子（C错）【功效】散风寒，通鼻窍，除湿止痛，止痒。蔓荆子（D错）【功效】疏散风热，清利头目，祛风止痛。淡豆豉（E错）【功效】解表，除烦。